队列研究与病例对照研究比较错误的说法是
A. 均是分析性研究方法
B. 均属于观察法
C. 均可以计算发病密度
D. 队列研究验证病因假设的能力较病例对照研究强
E. 队列研究适用于发病率较高的疾病病因的研究，而病例对照研究则可用于罕见病病因的研究

正确答案：C。均可以计算发病密度

解析：本题考查病例对照研究与队列研究的比较。队列研究与病例对照研究均是分析性研究方法（A对），均属于观察法（B对）。队列研究适用于发病率较高的疾病病因的研究，而病例对照研究则可用于罕见病病因的研究（E对）。队列研究验证病因假设的能力较病例对照研究强（D对）。队列研究可以计算发病密度，而病例对照研究不可以（C错，为本题正确答案）。病例对照研究不能测定暴露组和非暴露组疾病的发病率，不能直接分析RR，只能用OR来估计RR。